某男，76岁。小便点滴而下，尿如细线，甚则阻塞不通，小腹胀满，烦躁口苦，舌紫暗，苔黄腻，脉涩。诊断为癃闭，证属湿热瘀阻。可选用的中成药有
A. 前列通片
B. 癃闭舒胶囊
C. 热淋清颗粒
D. 前列通瘀胶囊
E. 前列舒丸

正确答案：A、B、D。前列通片；癃闭舒胶囊；前列通瘀胶囊

解析：本题考查的是癃闭的辨证论治。小便点滴而下，尿如细线，甚则阻塞不通，小腹胀满，烦躁口苦，舌紫暗，苔黄腻，脉涩。诊断为癃闭，证属湿热瘀阻。可选用的中成药有前列通片（A对）、癃闭舒胶囊（B对）与前列通瘀胶囊（D对）。癃闭是以小便量少，排尿困难，甚则小便闭塞不通为主症的疾病。（一）膀胱湿热证：【中成药应用】常用中成药有八正合剂、清淋颗粒。（二）湿热瘀阻证：【中成药应用】常用中成药有癃清片、前列通瘀胶囊、前列通片、癃闭舒胶囊。（三）肾阳衰惫证：【中成药应用】常用中成药有济生肾气丸、金匮肾气丸。热淋清颗粒（C错）可用于男性不育症湿热下注证。尿闭不通者不宜用。可酌情选用治疗湿热下注淋证、癃闭、精浊的中成药，来辅助治疗男性不育症湿热下注证，这些中成药包括八正合剂、癃清片、热淋清颗粒、三金片、前列通片、五淋化石丸、癃闭舒胶囊、前列回春片、男康片等。前列舒丸（E错）：功能扶正固本，益肾利尿。